关于酶活性中心的叙述，哪项不正确
A. 酶是具有一定空间结构的蛋白质或多肽链
B. 酶分子表面只有一小部分基团与酶的催化作用直接有关
C. 必需基团与维持酶分子的空间构象无关
D. 酶分子中与酶活性有关的化学基团为必需基团
E. 常见的必需基团有组氨酸的咪唑基

正确答案：C。必需基团与维持酶分子的空间构象无关

解析：酶是具有一定空间结构的蛋白质或多肽链。虽然酶分子表面有许多由氨基酸提供的化学基团，但其中只有一小部分基团与酶的催化作用直接有关。酶分子中与酶活性有关的化学基团称为必需基团。这些必需基团与维持酶分子的空间构象有关。掌握“酶的催化”知识点。